组织学表现为恶性者所占比例很高的疾病是
A. 白斑
B. 红斑
C. 扁平苔藓
D. 慢性盘状红斑狼疮
E. 口腔黏膜下纤维化

正确答案：B。红斑

解析：本题考查口腔红斑。组织学表现为恶性者所占比例很高的疾病是红斑（B对）。癌前病损是一种已知形态学上改变的组织，它较其外观相应正常的组织具有更大发癌可能。癌前状态是一种显著增加发癌危险的一般状态。口腔扁平苔癣、慢性盘状红斑狼疮、口腔黏膜下纤维化是癌前状态，白斑和红斑则是癌前病损。红斑的癌变危险性比白斑尤甚，在组织学上其恶性者所占的比例很高，临床上发现，80%的红斑患者病理切片证实为浸润癌或原位癌。白斑（A错）、口腔扁平苔癣（C错）、慢性盘状红斑狼疮（D错）和口腔黏膜下纤维化（E错）的恶性所占比例不如红斑。